下列疾病可表现为肠鸣音活跃的是
A. 上消化道出血
B. 肠系膜上动脉栓塞
C. 麻痹性肠梗阻
D. 急性胰腺炎
E. 上消化道穿孔

正确答案：A。上消化道出血

解析：肠系膜上动脉栓塞早期由于肠管痉挛，可出现肠鸣音活跃（B对），晚期肠缺血、坏死，肠鸣音消失。上消化道大出血时，肠腔内积血刺激肠管，使肠蠕动增强，肠鸣音活跃（A对）。本题AB均对。麻痹性肠梗阻（C错）、上消化道穿孔（E错）、急性胰腺炎（D错）时，肠鸣音减弱或消失。